鉴别流脑和其他化脓性脑膜炎最有价值的指标是
A. 起病急骤
B. 意识障碍
C. 皮肤出现淤点和淤斑
D. 脑膜刺激征
E. 脑脊液改变

正确答案：C。皮肤出现淤点和淤斑